多形性低度恶性腺癌主要发生于
A. 腮腺
B. 舌下腺
C. 下颌下腺
D. 腭腺
E. 唇腺

正确答案：D。腭腺

解析：多形性低度恶性腺癌主要发生于小唾液腺，约60%发生于腭部。掌握“多形性低度恶性腺癌”知识点。